男，43岁。肝炎肝硬化病史5年，出现腹腔积液1年，1周来低热伴轻度腹痛，腹腔积液明显增多。腹腔积液检查：淡黄色，比重1.017，蛋白质26g/L，白细胞500×10⁶/L，中性粒细胞0.80，最可能的诊断是肝硬化合并
A. 结核性腹膜炎
B. 自发性腹膜炎
C. 原发性肝癌
D. 门静脉血栓形成
E. 肝肾综合征

正确答案：B。自发性腹膜炎

解析：中年男性患者，肝炎肝硬化病史5年，出现腹水1年（自发性腹膜炎的好发原因），1周来低热伴轻度腹痛，腹水明显增多（自发性腹膜炎缓慢发病的常见症状）。腹腔积液检查：淡黄色（漏出液外观为淡黄色、浆液性；渗出液外观不定，可为血性、脓性、乳糜性等），比重1.017（漏出液低于1.018，渗出液高于1.018），蛋白26g/L（漏出液<25g/L，渗出液>30g/L），白细胞>500×10⁶/L（漏出液常<100×10⁶/L，渗出液常>500×10⁶/L），根据该患者的腹水生化检查判断腹水性质介于渗、漏出液之间；中性粒细胞0.80（中性粒细胞升高多提示细菌感染）。综合该病人的病史、体查、实验室检查，最可能的诊断是肝硬化合并自发性腹膜炎（B对）。结核性腹膜炎（P370）（A错）多有结核病史，长期不明原因发热，伴有腹壁柔韧感或腹部包块，腹水为渗出液，以淋巴细胞为主。原发性肝癌（P416）（C错）腹水多为漏出液，且多为血性。门静脉血栓形成（P409）（D错）常表现为剧烈腹痛、腹胀、血便、休克、短期内脾大、腹水迅速增加。肝肾综合征（P409）（E错）主要表现为少尿或无尿、氮质血症、血清肌酐升高等。